左心室的结构，不正确的描述是
A. 借二尖瓣的后尖瓣分为流入道和流出道
B. 入口为左房室口，出口为主动脉口
C. 室壁肌层较厚，是右心室的2～3倍
D. 舒张时，主动脉瓣被血液充盈而关闭，可防止主动脉内血液返流回左心室
E. 收缩时，二尖瓣关闭，可防止左心室内血液返流回左心房

正确答案：A。借二尖瓣的后尖瓣分为流入道和流出道

解析：左心室腔以二尖瓣前尖（A错，为本题正确答案）为界分为流入道和流出道。入口为左房室口，出口为主动脉口（B对）。左心室壁肌层较厚约是右室壁厚的三倍（C对）。舒张时，主动脉瓣被血液充盈而关闭，可防止主动脉内血液返流回左心室（D对）。收缩时，二尖瓣关闭，可防止左心室内血液返流回左心房（E对）。